黄芪的功效是
A. 补脾肺肾,固精止带
B. 补气养阴，清火生津
C. 补气健脾，止汗安胎
D. 补气升阳，利水消肿
E. 健脾化湿，消暑解毒

正确答案：D。补气升阳，利水消肿